发作性咳嗽多见于
A. 支气管炎
B. 支气管扩张
C. 肺结核
D. 百日咳
E. 声带炎症

正确答案：D。百日咳

解析：本题考查发作性咳嗽的常见原因。发作性咳嗽是指咳嗽呈阵发性发作，发作时咳声连续呈痉挛状态。发作性咳嗽一般是由急性咽喉炎、百日咳（D对ABCE错）、支气管哮喘引发的。